关于慢性肺源性心脏病治疗原则错误的是
A. 控制感染
B. 通畅呼吸道
C. 增强免疫力
D. 长期家庭氧疗
E. 以上均不是

正确答案：E。以上均不是

解析：急性加重期的治疗原则是积极控制感染、通畅呼吸道和改善呼吸功能、纠正缺氧和二氧化碳潴留以及控制呼吸衰竭和心力衰竭。肺心功能代偿期的治疗原则是采用中西医结合的综合措施，增强患者的免疫功能，去除诱发因素，减少或避免急性加重期的发生，长期家庭氧疗,争取使肺、心功能得到部分或全部恢复。掌握“慢性肺源性心脏病”知识点。